女，27岁。劳累后心悸、气短5年，近一周间断咯血，无发热。查体：双颊紫红，口唇轻度发绀，颈静脉无怒张。两肺未闻及干湿啰音。心浊音界在胸骨左缘第三肋间向左扩大。心尖部局限性舒张期隆隆样杂音，第一心音亢进。肝脏不大，下肢无水肿。本病诊断应首先考虑
A. 肺结核
B. 风湿性心脏病二尖瓣狭窄
C. 室间隔缺损
D. 扩张型心肌病
E. 风湿性心脏病二尖瓣关闭不全

正确答案：B。风湿性心脏病二尖瓣狭窄